治疗行痹，应首选
A. 乌头汤
B. 薏苡仁汤
C. 防风汤
D. 宣痹汤
E. 白虎加桂枝汤

正确答案：C。防风汤

解析：行痹的病机是风邪兼夹寒湿，留滞经脉，闭阻气血。治疗应祛风通络，散寒除湿，首选防风汤（C对）。乌头汤为痛痹的代表方（A错）。薏苡仁汤为着痹的代表方（B错）。宣痹汤主治风湿热痹（D错）。白虎加桂枝汤为风湿热痹的代表方（E错）。